心脏肌源性扩张时
A. 心脏扩张
B. 心肌收缩力增强
C. 两者均有
D. 两者均无
E. 无

正确答案：A。心脏扩张

解析：长期前负荷过重时，心脏扩张，心肌肌节长度被拉伸超过2.2μm（产生最大收缩力时的肌节长度），粗细肌丝不能充分重叠，有效横桥的数目减少，心肌收缩力降低，这种心脏扩张（A对）不伴心肌收缩力增强（B错）的情况称为心脏肌源性扩张。